属于浓度依赖型抗菌药物，通常铜绿假单胞菌对其敏感的药物是
A. 阿米卡星
B. 氨曲南
C. 氨苄西林
D. 头孢他啶
E. 头孢曲松

正确答案：A。阿米卡星

解析：本题考查抗菌药物。属于浓度依赖型抗菌药物，通常铜绿假单胞菌对其敏感的药物是阿米卡星（A对）。阿米卡星为氨基糖苷类药物，氨基糖苷类药为浓度依赖型速效杀菌剂。氨曲南（B错）属于单酰胺菌素类药物，时间依赖型。氨苄西林（C错）为半合成的广谱青霉素，属氨基青霉素类，其抗菌作用机制与青霉素相同，系通过与细菌主要青霉素结合蛋白结合，干扰细菌细胞壁的合成而起抗菌作用，其作用特点是广谱，不耐青霉素酶。头孢他啶（D错）属于第三代头孢菌素，通常铜绿假单胞菌对其敏感。头孢曲松（E错）也属第三代头孢菌素，但对铜绿假单胞菌作用不及头孢他啶。